男，16岁。溺水，经急救后送来急诊。查体：P120次/分，R32次/分，BP95/65mmHg，神志清楚，口唇发绀，双肺可闻及湿啰音。面罩吸氧后氧饱和度监测显示为85%。该患者应立即采取的治疗措施是
A. 静脉注射地塞米松
B. 静脉注射毛花苷丙
C. 无创通气
D. 皮下注射吗啡
E. 静脉注射呋塞米

正确答案：C。无创通气

解析：患者为青年男性，有溺水史（此为急性呼吸窘迫综合征危险因素），口唇发绀，双肺可闻及湿啰音，面罩吸氧后氧饱和度监测显示为85%（有急性呼吸窘迫综合征的典型表现，顽固性低氧血症），根据其临床表现和辅助检查，考虑诊断急性呼吸窘迫综合征（ARDS）。应立即采取的措施是无创通气（C对），维持充分的氧合和通气，以支持脏器功能。静脉注射地塞米松（A错）在ARDS中的治疗价值尚不确定。静脉注射毛花苷丙（B错）主要用于伴有心房颤动/心房扑动得收缩性心力衰竭。皮下注射吗啡（D错）可以抑制呼吸中枢，患者口唇发绀，吸氧后氧饱和度升高不明显，已出现明显呼吸抑制的症状，因而禁忌吗啡。静脉注射呋塞米（E错）属于利尿药，可降低血压，患者BP95/65mmHg，血压不高，避免使用呋塞米等，以免出现休克。